在流行病学调查中，系统抽样的方法是
A. 将对象编号，再用随机数字表抽样
B. 先将对象主要特征分层，再随机抽样
C. 将总体分为若干群，然后随机抽样
D. 按一定顺序，机械地每隔一定的数量单位抽取一个单位
E. 以上都不对

正确答案：D。按一定顺序，机械地每隔一定的数量单位抽取一个单位

解析：系统抽样是首先将总体中各单位按一定顺序，机械地每隔一定的数量单位抽取一个单位（D对），是纯随机抽样的变形。将对象编号，再用随机数字表抽样（A错）属于单纯随机抽样（P049）的方法。先将对象主要特征分层，再随机抽样（B错）属于分层抽样（P049）的方法。将总体分为若干群，然后随机抽样（C错）属于整群抽样。